食物脂肪消化吸收后进入血液的主要方式是
A. 甘油及脂肪酸
B. 甘油二酯及脂肪酸
C. 甘油一酯及脂肪酸
D. 乳糜蛋白
E. 甘油三酯

正确答案：D。乳糜蛋白